仅用于绝经后妇女，不适用于男性患者的抗骨质疏松药物是
A. 雷洛昔芬
B. 阿仑膦酸钠
C. 阿法骨化醇
D. 骨化三醇
E. 降钙素

正确答案：A。雷洛昔芬

解析：本题考查药物的作用。雷洛昔芬（A对）是选择性雌激素受体调节剂，对雌激素作用的组织有选择性的激动或拮抗活性，用于预防绝经后妇女的骨质疏松症，且仅用于绝经后妇女，不适用于男性患者。降钙素（E错）适用于绝经后骨质疏松症及老年骨质疏松症。阿仑膦酸钠（B错）用于绝经后妇女的骨质疏松症，治疗男性骨质疏松症以预防髋部和脊椎骨折。骨化三醇（D错）用于绝经后及老年性骨质疏松。阿法骨化醇（C错）用于佝偻病和软骨病、肾性骨病、骨质疏松症和甲状旁腺功能减退症。